在非处方药的遴选原则中，使用方便是指
A. 治疗期间不需要经常调节剂量
B. 包装严密，有效期及生产批号明确
C. 对不同使用者，说明使用剂量，便于掌握
D. 不需医师辨证和检查
E. 临床长期使用证明其安全性大

正确答案：C。对不同使用者，说明使用剂量，便于掌握